连续地、系统地收集疾病的资料，经过分析、解释后及时将信息反馈给所有应该知道的人，并且利用检测信息过程，称为
A. 疾病监测
B. 长期变异
C. 临床预防
D. 健康维护
E. 健康咨询

正确答案：A。疾病监测

解析：疾病监测是指连续地、系统地收集疾病的资料，经过分析、解释后及时将信息反馈给所有应该知道的人，并且利用监测信息的过程。掌握“流行病的诊断和筛检试验及疾病监测”知识点。